洋地黄毒苷片的含量测定，中国药典采用的方法是
A. 比色法
B. 紫外分光光度法
C. 红外分光光度法
D. 荧光分析法
E. 高效液相色谱法

正确答案：D。荧光分析法